处方开具当日有效。特殊情况下可以延长有效期。但有效期最长不得超过
A. 2天
B. 3天
C. 5天
D. 7天
E. 10天

正确答案：B。3天

解析：处方开具当日有效。特殊情况下需延长有效期的，由开具处方的医师注明有效期限，但有效期最长不得超过3天。掌握“处方的开具、监督管理及法律责任”知识点。